能弯腰取东西的月龄
A. 7月
B. 9月
C. 12月
D. 15月
E. 18月

正确答案：C。12月

解析：1周岁左右逐渐会走，弯腰取东西，会将圆圈套在木棍上。掌握“运动和语言发育”知识点。